下列哪项不是方药养生保健的应用原则
A. 渐进施药
B. 顺时选药
C. 因人用药
D. 辨证遣药
E. 多用补药

正确答案：E。多用补药

解析：方药养生是在中医药理论指导下，运用中药防治疾病、强身健体的一种养生方法，应遵循不宜骤补、渐进施药（E错，为本题正确答案。A对）；天人相应、顺时选药（B对）；注重体质、因人用药（C对）；扶正祛邪，辨证遣药（D对）的原则。